细菌与牙髓的距离不同，对牙髓的影响也不同，下列说法正确的是
A. 当细菌距离牙髓＜1.1mm，牙髓可发生明显的炎症
B. 当细菌距离牙髓＜0.5mm，牙髓可出现轻度炎症
C. 当细菌距离牙髓≤0.2mm，牙髓内可找到细菌
D. 当细菌距离牙髓＜0.2mm，牙髓可发生明显的炎症
E. 当细菌距离牙髓＜1.1mm，牙髓内可找到细菌

正确答案：C。当细菌距离牙髓≤0.2mm，牙髓内可找到细菌

解析：细菌在未进入牙髓腔之前，其毒性产物就可通过牙本质小管引起牙髓的炎症反应。当牙本质内的细菌距牙髓＜1.1mm时，牙髓可出现轻度炎症；＜0.5mm时，牙髓可发生明显的炎症；≤0.2mm时，牙髓内可找到细菌。掌握“牙髓疾病的病因及分类”知识点。